水杨酸与铁盐配伍，易发生
A. 变色
B. 沉淀
C. 产气
D. 结块
E. 爆炸

正确答案：A。变色

解析：本题考查药物的配伍变化。水杨酸与铁盐配伍，易发生变色（A对）。水杨酸含有酚羟基，与铁盐相遇可使颜色变深。生物碱溶液的沉淀：大多数生物碱的溶液，当与鞣酸、碘、碘化钾、乌洛托品相遇时能产生沉淀等。黄连素和黄芩苷在溶液中可产生难溶性沉淀（B错）。溴化铵和利尿药配伍，产生氨气（C错）。发生爆炸大多由强氧化剂与强还原剂配伍而引起。如氯化钾与硫，高锰酸钾与甘油，强氧化剂与蔗糖或葡萄糖等（E错）。